急性肾衰竭的主要病机是
A. 肺失宣肃
B. 脾失运化
C. 肾元亏虚
D. 瘀血阻络
E. 肾失气化

正确答案：E。肾失气化

解析：急性肾衰竭发生多与外感六淫疫毒、饮食不当、意外伤害、失血失液、中毒虫咬、药毒伤肾等因素有关，本病病位在肾，涉及肺、脾（胃）、三焦、膀胱，主要病机为肾失气化（E对），水湿浊瘀不能排出体外。初期主要为火热、湿毒、瘀浊之邪壅滞三焦，水道不利，以实热居多，后期以脏腑虚损为主。其常见的中医证型有热毒炽盛、火毒瘀滞、湿热蕴结、气脱津伤。